组织中具有晶鞘纤维的药材是
A. 人参
B. 甘草
C. 黄连
D. 黄芪
E. 天麻

正确答案：B。甘草

解析：本题考查的是甘草的显微鉴别。组织中具有晶鞘纤维的药材是甘草（B对）。甘草【显微鉴别】根横切面：木栓层为数列红棕色细胞。栓内层较窄。韧皮部及木质部中均有纤维束，其周围薄壁细胞中常含草酸钙方晶，形成晶鞘纤维。束内形成层明显。导管常单个或2～3成群。射线明显，韧皮部射线常弯曲，有裂隙。薄壁细胞含淀粉粒，少数细胞含棕色块状物。人参（A错）【显微鉴别】主根横切面：木栓层为数列细胞，栓内层窄。韧皮部外侧有裂隙，内侧薄壁细胞排列较紧密，有树脂道散在，内含黄色分泌物。形成层成环。木质部射线宽广，导管单个散在或数个相聚，径向稀疏排列成放射状，导管旁偶有非木化的纤维。薄壁细胞含草酸钙簇晶。黄连（C错）【显微鉴别】味连横切面：木栓层为数列细胞，其外有表皮，常脱落。皮层较宽，石细胞单个或成群散在，黄色，另有根迹维管束。中柱鞘纤维成束，木化，或伴有少数石细胞，均显黄色。黄芪（D错）【显微鉴别】横切面：木栓层细胞数列，栓内层为厚角细胞，切向延长。韧皮部有纤维束，与筛管群交替排列；近栓内层处有时可见石细胞及纵向管状木栓组织；韧皮射线外侧弯曲，有裂隙。薄壁细胞含淀粉粒。天麻（E错）【显微鉴别】横切面：最外有时有残留的表皮组织，浅棕色。下皮由2～3列切向延长的栓化细胞组成。皮层为10数列多角形细胞，较老块茎皮层与下皮相接处有2～3列椭圆形厚壁细胞，木化，纹孔明显。